继发性不孕的中医病名是
A. 全不产
B. 断续
C. 阻病
D. 暗产
E. 避年

正确答案：B。断续

解析：中医古籍原发性不孕症称为“全不产”（A错）、“绝产”、“绝嗣”、“绝子”等，继发性不孕称为“断续”（B对）。妊娠早期出现恶心呕吐，头晕倦怠，甚至食入即吐者，称为“妊娠恶阻”，亦称为“子病”、“病儿”、“阻病”（C错）。怀孕未足一月而流产者，其时胚胎尚未成形，人多不知有胎，故名“暗产”（D错）。在身体正常情况下，月经频率为每年一次称为“避年”（E错）。